下列关于脑膜炎奈瑟球菌叙述错误的是
A. 革兰氏阴性球菌
B. 直径0.6～0.8μm
C. 呈肾形，双排列
D. 无鞭毛、大多数有荚膜和菌毛
E. 易形成芽胞

正确答案：E。易形成芽胞

解析：脑膜炎奈瑟球菌：革兰氏阴性球菌，直径0.6～0.8μm，呈肾形，双排列，不形成芽胞，无鞭毛，大多数有荚膜和菌毛。营养要求较高，需用营养培养基——血琼脂（巧克力色）培养基才能培养，初次分离培养尚需5%～10%二氧化碳（CO2）气体环境。对外界抵抗力弱。掌握“肠球菌属及奈瑟菌属”知识点。